下列各项中，对于乙脑跟中毒性菌痢脑病的鉴别最有意义的是
A. 起病急骤
B. 大便检查有无炎性成分
C. 高热、昏迷、抽搐
D. 早期休克
E. 呼吸衰竭

正确答案：B。大便检查有无炎性成分

解析：乙脑和中毒性菌痢脑病均起病急骤（A错）、可出现高热、昏迷、抽搐（B错）、早期休克（C错）、呼吸衰竭（E错），难以鉴别，但中毒性菌痢脑病粪便镜检有大量白细胞、脓细胞及红细胞（B对），而乙脑粪便检查无炎性成分。